常用的伤害危险因素研究方法不包括
A. 病例对照研究
B. 队列研究
C. 社区干预研究
D. 捕获-标记-再捕获法
E. 动物实验

正确答案：E。动物实验

解析：本题考查常用的伤害危险因素研究方法。常用的伤害危险因素研究方法包括：病例对照研究（A对）、队列研究（B对）、社区干预研究（C对）、捕获-标记-再捕获法（D对）等。动物实验（E错，为本题正确答案）不是常用的伤害危险因素研究方法。